男，50岁。3周来反复出现上3层楼时胸痛，为闷痛，休息3分钟能缓解，不剧烈运动则无症状。诊断为心绞痛。该患者最可能的心绞痛临床类型是
A. 初发劳动型
B. 恶化劳动型
C. 自发型
D. 变异型
E. 稳定型

正确答案：E。稳定型

解析：患者中老年男性（冠心病好发人群），3周来反复出现上3层楼时胸痛，为闷痛，休息3分钟能缓解，不剧烈运动则无症状（常见心绞痛症状）结合患者病史和临床表现最可能的心绞痛临床类型是稳定型（E对）；恶化劳动型（B错）心绞痛多在近一个月内症状逐渐加重。变异型（D错）属于静息性心绞痛的一种，与劳力性心绞痛相比，疼痛持续时间长，程度重，且含服硝酸甘油不易缓解。初发劳动型（A错）心绞痛的特点是发病情况初发，不是反复，该患者发病时间尚短暂不构成稳定型心绞痛。心绞痛类型中无自发型（C错）。